依据《执业药师资格制度暂行规定》，执业药师注册机构为
A. 国家人事部
B. 省及地方级（食品）药品监督管理局
C. 省、自治区、直辖市（食品）药品监督管理局
D. 国家食品药品监督管理局
E. 省、自治区、直辖市人事厅（局）

正确答案：C。省、自治区、直辖市（食品）药品监督管理局

解析：本题考查执业药师。执业药师注册机构为省、自治区、直辖市（食品）药品监督管理局（C对）。国家药品监督管理局（D错）为全国执业药师资格注册管理机构，不是执业药师注册机构。